外感风热可引起的鼻及鼻内分泌物变化是
A. 鼻干少涕
B. 鼻头充血
C. 鼻流浊涕
D. 鼻流清涕
E. 久流腥臭涕

正确答案：C。鼻流浊涕